具有妊娠引产作用的化合物是
A. 猪苓多糖
B. 昆布素
C. 香菇多糖
D. 天门冬素
E. 天花粉蛋白

正确答案：E。天花粉蛋白

解析：本题考查的是蛋白质的应用。具有妊娠引产作用的化合物是天花粉蛋白（E对）。蛋白质大量存在于中药中，有些中药的蛋白质具有较强的生物活性。例如，天花粉蛋白有引产作用，临床用于中期妊娠引产，并可用于除去恶性葡萄胎；半夏鲜汁中的半夏蛋白具有抑制早期妊娠作用。猪苓多糖（A错）、昆布素（B错）为与香菇多糖（C错）为多糖类化合物。多糖存在于许多中药中，一些中药中的多糖具有很强的生物活性。如香菇多糖、灵芝多糖、猪苓多糖等均具有抗肿瘤作用；昆布中的昆布素有治疗动脉粥样硬化作用；黄芪多糖和人参多糖具有免疫调节作用；银耳多糖能有效地保护肝细胞等。天门冬素（D错）的应用，2022年考试指南未明确说明。